舌痿的病机是
A. 寒凝肝脉
B. 痰浊内停
C. 血热兼瘀
D. 风痰阻络
E. 气血虚极

正确答案：E。气血虚极

解析：本题考查的是望舌态。舌痿的病机是气血虚极（E对）。望舌态：望舌态，主要是观察舌体运动的变化，主要有如下几种。①强硬：舌体强硬，运动不灵活，屈伸不便，或不能转动，致使语言謇涩，称为“舌强”。若见于外感热病，多属热入心包、痰浊内阻（B错），或高热伤津、邪热炽盛。见于杂病中者，多为中风征兆。②痿软：舌体软弱，伸卷无力，转动不便，是为舌痿，多属气血虚极、阴液亏损、筋脉失养所致。若久病舌淡而痿，是气血俱虚；舌绛而痿，是阴亏已极。新病舌干红而痿者，则为热灼阴伤。③颤动：舌体震颤不定，不能自主，称为舌体颤动。久病中见舌颤，属气血两虚或阳气虚弱。外感热病中见之，多属热极生风或虚风内动之象。④吐弄：舌伸长，吐露出口外者为吐舌；舌时时微出口外，立即收回口内，或舌舔口唇上下或口角左右，称为弄舌。两者都属心脾有热。吐舌可见于疫毒攻心，或正气已绝；弄舌多为动风先兆，或小儿智能发育不良。⑤㖞斜：舌体偏斜于一侧，称为㖞斜。多是中风或中风之先兆。⑥短缩：舌体紧缩不能伸长，称为短缩，多是危重证候的反映。舌淡或青而湿润短缩，多属寒凝筋脉（A错）；舌胖而短缩，属痰湿内阻；舌红绛干而短缩，多属热病津伤。风痰阻络（D错）为中风的病机之一，中风舌态多见㖞斜。血热兼瘀（C错）的舌态，2022年考试指南未明确说明。